不符合无牙颌印模要求的是
A. 印模细致、清晰
B. 边缘尽量伸展
C. 边缘要圆钝，有一定厚度
D. 组织受压均匀
E. 采取功能性印模

正确答案：B。边缘尽量伸展

解析：本题考查无牙颌印模的要求。边缘尽量伸展（B错，为本题正确答案）不符合无牙颌印模要求。无牙颌印模的边缘要适度伸展，以不影响黏膜皱襞、软腭、系带的功能性活动为前提，否则会损伤口腔黏膜，并影响义齿固位。无牙颌印模要求细致清晰（A对），准确反映口腔内的组织结构形态，其边缘要圆钝，并有一定的厚度（C对），避免刮伤口腔黏膜。在制取印模时，要使用正确的材料和方法，并应注意压力要均匀（D对），否则影响印模的准确性。无牙颌印模要制取功能性印模（E对），以反映周围组织的功能形态。